生物转化酶主要位于
A. 内质网和线粒体
B. 线粒体和细胞核
C. 细胞核和胞液
D. 胞液和内质网

正确答案：D。胞液和内质网

解析：本题考查生物转化酶的主要部位。在肝脏和大多数组织的细胞中，生物转化酶主要位于内质网和胞液（D对ABC错）。